不属于新斯的明的不良反应的是
A. 严重便秘
B. 心动过缓
C. 肌肉震颤
D. 可引起"胆碱能危象"
E. 肌无力加重

正确答案：A。严重便秘

解析：新斯的明治疗量时副作用较小，过量时可引起"碱能危象"（D对），产生恶心、呕吐、腹痛、心动过缓（B对）、肌肉震颤（C对）和肌无力加重（E对）等，甚至呼吸衰竭死亡（A错，为本题正确答案）。